郑声的病因多为
A. 心气大伤
B. 心气不足
C. 痰火扰心
D. 风痰阻络
E. 热扰心神

正确答案：A。心气大伤

解析：郑声指神识不清，语言重复，时断时续，语声低弱模糊的症状。多因久病心气大伤，精神散乱所致，属虚证（A对）。因心气不足，神失所养，多可见独语（B错）。因痰火扰心，多可见狂证（C错）。因风痰阻络，多可见语言蹇涩（D错）。因热扰心神，多可见谵语（E错）。